关于标准差，错误的一项是
A. 反映全部观察值的离散程度
B. 最适用于对称分布资料
C. 反映了均数代表性的好坏
D. 一定大于或等于零
E. 不会小于算术均数

正确答案：E。不会小于算术均数

解析：本题考查标准差的相关内容。标准差是方差的平方根。实际应用中，因为标准差的单位与原始观测值的单位一致，更多使用标准差（A对）而非方差反映数据的离散程度。标准差一般与均数结合使用，描述不含离群值的对称分布（B对）的分布特征。标准差越小反映均数代表性越好，反之，标准差越大反映均数代表性越差 （C对）。标准差=√方差，所以标准差一定大于或等于零（D对）标准差可以小于算数均数，标准差的大小只反映均数代表性的好坏（E错，为本题的正确答案）。